医患双方都具有独立人格要求医师做到
A. 不伤害患者
B. 从各方面关心患者
C. “患者是上帝”
D. 平等待患
E. 关心患者心理需求

正确答案：D。平等待患

解析：医患双方都具有独立人格要求医师做到平等待患，平等交往、一视同仁是医务人员处理医患关系时应该遵守的重要准则（D对）。